实施卫生法中的行政处罚的卫生行政主管机关是县级以上的
A. 司法部门
B. 卫生行政管理部门
C. 卫生组织社会团体
D. 药品监督管理部门
E. 工商行政管理部门

正确答案：B。卫生行政管理部门

解析：实施卫生法中的行政处罚的卫生行政主管机关是县级以上的卫生行政管理部门（B对C错）。司法部门的工作就是维护法律、确保法律被正确的执行、解决争议（A错）。国家食品药品监督管理局是国务院综合监督食品、保健品、化妆品安全管理和主管药品监管的直属机构（D错）。国家工商行政管理总局负责组织、指导、协调全国工商行政管理工作；省、自治区、直辖市工商行政管理局是同级人民政府的职能机构，负责组织、指导、协调本行政辖区内的工商行政管理工作，对同级人民政府负责并报告工作，其业务工作接受国家工商行政管理局监督与指导（E错）。